下列哪项不是肝火上炎证与肝阳上亢证的共见症状
A. 失眠多梦
B. 急躁易怒
C. 头重足飘
D. 面红目赤
E. 头晕胀痛

正确答案：C。头重足飘

解析：肝阳上亢的证候表现为头目胀痛，眩晕耳鸣，面红目赤，急躁易怒，失眠多梦，腰膝酸软，头重脚轻，舌红少津，脉弦或弦细数。肝火上炎证的证候表现为头目胀痛，眩晕，面红目赤，口苦口干，急躁易怒，失眠多梦，耳鸣耳聋，或耳痛流脓，或胁肋灼痛，或吐血衄血，大便秘结，小便短黄，舌红苔黄，脉弦数（C错，为本题正确答案）。